消费者和经营者发生消费权益争议的解决途径中，其结果具有强制执行力的最后解决手段是
A. 请求消费者协会组织调解
B. 与经营者协商和解
C. 向有关行政部门申请行政裁决
D. 向人民法院提起诉讼

正确答案：D。向人民法院提起诉讼

解析：本题考查的是消费者和经营者争议的解决。消费者和经营者发生消费权益争议的解决途径中，其结果具有强制执行力的最后解决手段是向人民法院提起诉讼（D对）。行政强制执行：行政强制执行，是指行政机关或者行政机关申请人民法院，对不履行行政决定的公民、法人或者其他组织，依法强制履行义务的行为。行政强制执行的方式包括：①加处罚款或者滞纳金；②划拨存款、汇款；③拍卖或者依法处理查封、扣押的场所、设施或者财物；④排除妨碍、恢复原状；⑤代履行；⑥其他强制执行方式。《中华人民共和国消费者权益保护法》第六章争议的解决第三十九条：消费者和经营者发生消费者权益争议的，可以通过下列途径解决：（一）与经营者协商和解（B错）；（二）请求消费者协会或者依法成立的其他调解组织调解（A错）；（三）向有关行政部门投诉（C错）；（四）根据与经营者达成的仲裁协议提请仲裁机构仲裁；（五）向人民法院提起诉讼。